牙膏中起保持湿润作用的是
A. 摩擦剂
B. 洁净剂
C. 湿润剂
D. 胶黏剂
E. 防腐剂

正确答案：C。湿润剂

解析：本题考查牙膏的基本成分和作用。牙膏中起保持湿润作用的是湿润剂（C对）。牙膏的基本成分和作用：1.摩擦剂（A错）：通过刷牙时的机械摩擦作用，摩擦剂可帮助清洁与磨光牙面，使牙面清洁、光滑、发亮，去除色素沉着、菌斑。理想的摩擦剂清洁能力强，对牙面无损伤，提供高度磨光，能防止色素再沉着。摩擦剂约占牙膏含量的20%～60%。常用的摩擦剂有碳酸钙、焦磷酸钙、磷酸氢钙、氢氧化铝、二氧化硅、硅酸盐等。2.洁净剂（B错）：又称发泡剂或表面活化剂，约占1%～2%。它可以降低表面张力，穿通与松解表面沉积物与色素，乳化软垢，刷牙时易被清除，以及有助于产生许多人喜欢的发泡作用。3.保湿剂：占20%～40%，作用是保持湿润，防止膏体接触空气而硬化并使剂型保持稳定，常用的有甘油（丙三醇）、聚乙二醇和山梨醇，这些制剂需防腐，以防止微生物生长。4.胶黏剂（D错）：约占1%～2%，作用是防止膏体在贮存期间固体与液体成分分离，保持均质性，常用的有机亲水胶体，如羧甲基纤维素钠及合成纤维素衍生物，有机胶体需防腐，以阻止微生物生长。5.芳香剂：牙膏中加入适量芳香剂以调节牙膏的味道和口感。芳香剂和甜味剂成分共占约2%～3%。6.防腐剂（E错）：约占0.1%～0.5%，作用是防止细菌生长，延长贮存期限，并使其他成分相容，常用乙醇、苯甲酸盐及二氯化酚等。7.水：水分作为溶媒，约占20%～40%。